毛果芸香碱对眼睛作用的表现是
A. 松弛瞳孔括约肌、降低眼内压、收缩睫状肌
B. 收缩瞳孔括约肌、降低眼内压、松弛睫状肌
C. 松弛瞳孔括约肌、升高眼内压、松弛睫状肌
D. 收缩瞳孔括约肌、升高眼内压、松弛睫状肌
E. 收缩瞳孔括约肌、降低眼内压、收缩睫状肌

正确答案：E。收缩瞳孔括约肌、降低眼内压、收缩睫状肌

解析：动眼神经兴奋时，环状肌向瞳孔中心方向收缩，睫状肌收缩（E对B错），结果使悬韧带松弛，晶状体变凸，屈光度增加，调节于近视。毛果芸香碱属于胆碱能M受体激动剂，能直接作用于副交感神经（包括支配汗腺交感神经）节后纤维支配的效应器官的M胆碱受体，尤其对眼和腺体作用明显，可激动瞳孔括约肌的M胆碱受体，使瞳孔括约肌收缩（AC错），瞳孔缩小。房水回流障碍可引起眼内压升高，引起青光眼，毛果芸香碱通过缩瞳作用可使虹膜向眼球中心拉紧，虹膜根部变薄，从而使处于虹膜周围的前房角间隙扩大，房水易于经滤帘进入虹膜静脉窦，使眼内压降低（D错）。眼睛能够调节视物的功能取决于晶状体的曲度变化，晶状体囊富于弹性，促使晶状体有略呈球形的倾向，但由于悬韧带向外缘的牵拉而使之维持于比较扁平的状态，悬韧带又受睫状肌的控制，睫状肌由环状和辐射状两种平滑肌纤维组成，其中以胆碱能神经（动眼神经）支配的环状肌纤维为主。